阵发性睡眠性血红蛋白尿患者，尿液改变的特点是
A. 肉眼血尿
B. 镜下血尿
C. 酱油色尿
D. 胆红素尿
E. 乳糜尿

正确答案：C。酱油色尿

解析：阵发性睡眠性血红蛋白尿症是一种获得性红细胞膜缺陷引起的慢性血管内溶血，常在睡眠时加重，可伴发作性血红蛋白尿，尿液呈现浓茶色或酱油色（C对）。每升尿液中含血量>1mL，即可呈淡红色、洗肉水样或混血样尿，称为肉眼血尿。血尿多见于各种肾小球疾病、泌尿系感染、结石、结核、肿瘤、外伤及全身出血性疾病（如血小板减少性紫癜、过敏性紫瘢）等（A错）。若每个高倍视野红细胞>3个，尿外观无血色者，称为镜下血尿血尿常见于急慢性肾小球肾炎、泌尿系感染、肾结核、肾结石、狼疮肾炎及全身出血性疾病等（B错）。胆红素尿常见于各种原因所致的肝细胞性及阻塞性黄疸（D错）。因肾周围淋巴通道阻塞，从肠道吸收的淋巴液逆流进入尿中所致，如同时含有较多的血液则称为乳糜血尿。常见于丝虫病、少数因肾结核、肿瘤（E错）。